涂料中可能导致机体过敏反应的成分是
A. 铅
B. 镉
C. SO
D. 漆酚
E. 光亮剂

正确答案：D。漆酚

解析：本题考查涂料中可能导致机体过敏反应的成分。一些涂料如大漆中含有大量的漆酚（D对ABCE错），毒性很大，常会导致机体过敏，引起变应性皮炎。